三价砷在机体内蓄积量较高的组织是
A. 肝脏
B. 毛发、皮肤
C. 肺、脾
D. 肠、胃
E. 肾脏

正确答案：B。毛发、皮肤

解析：本题考查三价砷在机体内蓄积量较高的组织。砷在体内有较强的蓄积性，特别是三价砷极易与疏基结合，并于吸收后24小时内分布于富含疏基的组织器官，例如肝、肾、脑等实质性脏器。由于三价砷易与角蛋白结合，故易蓄积于角蛋白含量高的皮肤、指（趾）甲、毛发（B对ACDE错）之中。